医生对于患者的行为和表情细心观察，并给予回应，属于
A. 言语沟通
B. 非言语沟通
C. 言语沟通和非言语沟通
D. 目光沟通
E. 以上都不是

正确答案：B。非言语沟通

解析：非言语沟通指的是医生可以通过微笑、点头、注视、身体前倾等表情和姿势表达对被评估者的接受、肯定、关注、鼓励等思想感情，故医生对于患者的行为和表情细心观察，并给予回应，属于非言语沟通（B对E错）。言语沟通（AC错）中，包含了听与说，听有时比说更重要。评估者要耐心地倾听被评估者的表述，抓住问题的每个细节，还要注意搜集被评估者的情绪状态、行为举止、思维表达、逻辑性等方面的情况，综合地分析和判断，为评估提供依据。目光沟通（D错）不属于医生会谈的方式。